用于计算生物利用度的是
A. 零阶矩
B. 平均稳态血药浓度
C. 一阶矩
D. 平均吸收时间
E. 平均滞留时间

正确答案：A。零阶矩

解析：本题考查药动学参数。用于计算生物利用度的是零阶矩（A对）。生物利用度包括两方面内容：药物吸收速度与药物吸收程度。吸收速度常用血药浓度-时间曲线的达峰时间Tmax来表示；吸收程度用血药浓度-时间曲线下面积AUC来表示，其定义为药-时曲线的零阶矩；平均稳态血药浓度（B错）的定义为：重复给药达稳态后，在一个给药间隔时间内，血药-时曲线下面积除以给药间隔时间τ的商值；药-时曲线的一阶矩（C错）定义为时间与血药浓度的乘积-时间曲线下的面积（AUMC）；药物进入体循环之前的所有时间称为平均吸收时间（MAT）（D错）；平均滞留时间（E错）是指所有药物分子在体内滞留的平均时间，即单次给药后所有药物分子在体内滞留时间的平均值。